治疗阳痿肾阳不足证，应选用
A. 丁香
B. 细辛
C. 花椒
D. 小茴香
E. 高良姜

正确答案：A。丁香

解析：该题考查丁香的应用。丁香具有温中降逆，散寒止痛，温肾助阳的功效，入肾经，有温肾助阳起痿之功（A对）。细辛具有解表散寒，祛风止痛，通窍，温肺化饮的功效（B错）。花椒具有温中止痛，杀虫止痒的功效（C错）。小茴香具有散寒止痛，理气和胃的功效（D错）。高良姜具有散寒止痛，温中止呕的功效（E错）。